女，40岁，发现右乳肿物1年，病初约花生米大小，近半年肿物增大，无特殊不适。查体：右乳外上限可触及4cm×3cm质硬肿物，皮肤无粘连。右侧腋窝淋巴结可触及肿大、质硬淋巴结，融合成团，右侧锁骨上淋巴结未触及。乳房x线摄影：右乳可见4cm×3cm高密度影，周边成毛刺状，中央可见强回声钙化点。其余检查未见远处转移。该患者行乳房改良性根治术后，术后病理为浸润性导管癌，淋巴结转移：4/20，ER（-），PR（-），HER2（-），则接下来治疗应选择
A. 放疗
B. 化疗
C. 放疗+化疗
D. 靶向治疗
E. 内分泌治疗

正确答案：C。放疗+化疗

解析：根据题干内容患者目前是属于乳腺癌III期术后，化疗杀灭手术后残存的肿瘤细胞；保留乳房的乳腺癌手术后，放射治疗是重要组成部分，应该予以放疗+化疗（C对AB错）。内分泌治疗：乳腺癌细胞中雌激素受体(ER)含量高者，称激素依赖性肿瘤，这些病例对内分泌治疗有效ER含量低者，称激素非依赖性肿瘤，这些病例对内分泌治疗反应差。因此，对激素受体阳性的病例应使用内分泌治疗（E错）。靶向治疗通过转基因技术制备的曲妥珠单抗对HER2过度表达的乳腺癌病人有良好效果，可降低乳腺癌病人术后的复发转移风险，提高无病生存期（D错）。